患者，男，58岁。患糖尿病15年。检查：双下肢浮肿，尿蛋白（﹢﹢﹢），空腹血糖8.0mmol/L，餐后2小时血糖11.13mmol/L，血压160/100mmHg，其诊断是
A. 高血压1级合并糖尿病
B. 糖尿病肾病
C. 慢性肾炎合并糖尿病
D. 糖尿病合并肾盂肾炎
E. 糖尿病肾炎

正确答案：B。糖尿病肾病

解析：患者有糖尿病病史，现空腹血糖8.0mmol/L，餐后2小时血糖11.13mmol/L。血压160/100mmHg。根据这些症状可诊断为糖尿病，且尿蛋白（﹢﹢﹢），双下肢浮肿可以确诊为糖尿病肾病（B对）。高血压1级合并糖尿病（A错）主要表现为高血压症状；慢性肾炎合并糖尿病（C错）表现为发热、血尿；糖尿病合并肾盂肾炎（D错）有发热、尿频、尿急、尿痛及腰背疼痛；糖尿病肾炎（E错）会有尿频、尿急、尿痛的表现。